在指导合理用药时，应交代宜在睡前服用的药物是
A. 辛伐他汀
B. 双膦酸盐
C. 苯妥英钠
D. 硫酸亚铁
E. 硫糖铝

正确答案：A。辛伐他汀

解析：本题考查药品服用的适宜时间。在指导合理用药时，应交代宜在睡前服用的药物是辛伐他汀（A对）。胆固醇主要在夜间合成，辛伐他汀夜间服药比白天更有效。双膦酸盐（B错）服用后需多饮水。苯妥英钠（C错）、硫酸亚铁（D错）宜在餐后服用。硫糖铝（E错）服药后在胃中形成保护膜，服药后1小时内尽量不喝水，避免保护层被水冲掉。